按十二经脉的流注次序，小肠经流注于
A. 膀胱经
B. 胆经
C. 三焦经
D. 心经
E. 胃经

正确答案：A。膀胱经

解析：十二经脉流注次序中，小肠流注于膀胱经（A对）。三焦经流注于胆经（B错）。心包经流注于三焦经（C错）。脾经流注于心经（D错）。大肠经流注于胃经（E错）。推荐记忆：肺大胃脾心小肠，膀肾包焦胆肝详。